下列关于口轮匝肌的叙述中，正确的是
A. 口轮匝肌呈扁环形排列，肌纤维位于上、下唇内
B. 口轮匝肌深层在口角处由颊肌和唇周围肌的部分纤维构成
C. 口轮匝肌浅层由固有肌纤维构成，从唇的一侧至另一侧
D. 主要作用是闭唇，封闭口腔
E. 以上均正确

正确答案：E。以上均正确

解析：口轮匝肌：呈扁环形排列，肌纤维位于上、下唇内，浅层由固有肌纤维构成，从唇的一侧至另一侧，中层由唇周围肌的上、下组的肌纤维交织而成，深层在口角处由颊肌和唇周围肌的部分纤维构成。主要作用是闭唇，封闭口腔，并参与吮吸、进食、咀嚼与发音。掌握“表情肌、舌腭肌”知识点。